某县城有6所小学，5所初中和3所高中：所属乡镇有10所中心小学，24所村小学和6所初中。该县疾病预防控制中心学校卫生科为了观察本县学生的生长发育动态拟开展调查。为减少季节等因素对监测结果的影响，建议每年的监测时间定在
A. 1～2月
B. 3～4月
C. 5～8月
D. 9～10月
E. 11～12月

正确答案：C。5～8月